能够在牙髓成纤维细胞更新时吞噬死亡细胞的是
A. 成纤维细胞
B. 成牙本质细胞
C. 树突状细胞
D. T淋巴细胞
E. 巨噬细胞和未分化的间充质细胞

正确答案：E。巨噬细胞和未分化的间充质细胞

解析：巨噬细胞和未分化的间充质细胞：这些细胞通常位于小血管及毛细血管周围。巨噬细胞较大，椭圆形或梭形，胞核染色深。活体染色可见其胞质内储有染料颗粒。电镜下胞质含溶酶体。在非活动时期很难与成纤维细胞相鉴别。巨噬细胞在牙髓成纤维细胞更新时能吞噬死亡细胞，也在炎症时发挥作用。掌握“牙髓”知识点。